设有对照组但未用随机方法分组的研究属于
A. 一级证据
B. 二级证据
C. 三级证据
D. 四级证据
E. 五级证据

正确答案：C。三级证据